关于抗结核药物副作用下列哪条是错误的
A. 异烟肼：肝功损害
B. 利福平：肝功损害
C. 吡嗪酰胺：耳毒性
D. 链霉素：耳鸣耳聋
E. 乙胺丁醇：视神经炎

正确答案：C。吡嗪酰胺：耳毒性

解析：异烟肼：主要不良反应是周围神经炎，偶有肝功能损害；利福平：主要不良反应是肝功能损害、过敏反应；链霉素：主要不良反应是听力障碍、眩晕、肾功能损害；利福平：主要不良反应是肝功能损害、过敏反应；乙胺丁醇：主要不良反应是视神经炎；吡嗪酰胺：主要不良反应为肝损害、高尿酸血症、食欲不振，关节痛等。掌握“肺结核”知识点。